全球气候变暖的原因主要是
A. 地面大气中臭氧浓度增加
B. 地面大气中温室效应气体增加
C. 地面太阳紫外线辐射增加
D. 雨雪水减少
E. 绿地减少

正确答案：B。地面大气中温室效应气体增加

解析：本题考查全球气候变暖的原因。全球气候变暖的原因主要是地面大气中温室效应气体增加（B对ACDE错）。温室效应是指大气层中某些气体如CO₂等能吸收地表发射的热辐射，使大气增温。